根据化妆品批准文号管理的有关规定，国产非特殊用途化妆品
A. 由省级药品监督管理部门负责备案管理
B. 由省级药品监督管理部门负责许可管理
C. 由国家药品监督管理部门负责许可管理
D. 不需要取得许可也不需要申请备案

正确答案：A。由省级药品监督管理部门负责备案管理

解析：本题考查化妆品生产经营管理方式和批准文号管理。根据化妆品批准文号管理的有关规定，国产非特殊用途化妆品由省级药品监督管理部门负责备案管理（A对）。化妆品生产经营管理方式和批准文号管理：特殊化妆品经国务院药品监督管理部门注册后方可生产、进口。国产普通化妆品应当在上市销售前向备案人所在地省、自治区、直辖市人民政府药品监督管理部门备案。进口普通化妆品应当在进口前向国务院药品监督管理部门备案。